下列关于乳牙牙髓炎临床表现特点的叙述，不正确的是
A. 深龋感染是引起乳牙牙髓病的唯一原因
B. 乳牙牙髓病以慢性炎症为主
C. 临床上往往见到深龋洞
D. 龋蚀未去净露髓,往往说明牙髓已经感染
E. 乳牙牙髓感染可伴发牙根吸收

正确答案：A。深龋感染是引起乳牙牙髓病的唯一原因

解析：本题考查乳牙牙髓病临床表现特点。下列关于乳牙牙髓炎临床表现特点的叙述，不正确的是深龋感染是引起乳牙牙髓病的唯一原因（A错，为本题的正确答案）。乳牙牙髓病临床表现特点：乳牙牙髓病包括牙髓炎症、牙髓坏死和牙髓变性。乳牙牙髓病多由深龋感染引起，为龋病的并发症。除龋病感染外，牙齿外伤也可引起。乳牙牙髓病临床症状不明显，以慢性炎症为主（B对），急性炎症往往是慢性炎症急性发作引起。临床上往往见到深龋洞（C对），一定要进行深龋和慢性牙髓炎的鉴别。龋蚀未去净露髓，往往说明牙髓已经感染（D对）。没有疼痛并不能说明牙髓没有感染，一定要结合临床检查综合判断。乳牙牙髓感染可伴发牙根吸收（E对），感染波及根髓时可有叩痛。